某男，40岁。患阳痿不育多年，证属肾阳亏虚，精滑不固，治当补肾助阳、固精缩尿，宜选用的药物是
A. 诃子
B. 金樱子
C. 莲子肉
D. 桑螵蛸
E. 肉豆蔻

正确答案：D。桑螵蛸

解析：本题考查的是桑螵蛸的功效。治当补肾助阳、固精缩尿，宜选用的药物是桑螵蛸（D对）。桑螵蛸：【功效】固精缩尿，补肾助阳。诃子（A错）：【功效】涩肠，敛肺，下气，利咽。金樱子（B错）：【功效】固精缩尿，涩肠止泻，固崩止带。莲子肉（C错）：【功效】补脾止泻，益肾固精，止带，养心安神。肉豆蔻（E错）：【主治病证】（1）久泻不止。（2）虚寒气滞之脘腹胀痛、食少呕吐。